两步滴定法测定阿司匹林片的含量时，每1ml氢氧化钠溶液（0.1mol/L）相当于阿司匹林（分子量=180.16）的量是
A. 18.02mg
B. 180.2mg
C. 90.08mg
D. 45.04mg
E. 450.0mg

正确答案：A。18.02mg

解析：本题考查两步滴定法。两步滴定法测定阿司匹林片的含量时，每1ml氢氧化钠溶液（0.1mol/L）相当于阿司匹林（分子量=180.16）的量是18.02mg（A对）。两步滴定法滴定时，阿司匹林的含量是以第二步消耗的氢氧化钠量计算的，由于第一步中和了所有的酸，包括阿司匹林结构中的羧基，故在第二步水解中，1mol阿司匹林仅消耗1mol氢氧化钠。滴定度T=180.16×0.1=18.02mg。